女，22岁。左额部被刀划伤12小时就诊。查体：左额部有3cm长伤口，深及骨膜，有血痂，伤口周边无红肿。宜采取的处理方法是
A. 清创后二期缝合
B. 清创后一期缝合
C. 清创后旋转橡胶片引流
D. 伤口敷料覆盖
E. 局部应用抗生素

正确答案：B。清创后一期缝合

解析：清创时间越早越好，伤后6～8小时内清创一般都可达到一期愈合（P129）。但面部伤口为减少瘢痕形成，可延长至12小时或更长时限（B对）。